女性，30岁。患甲状腺功能亢进症。在左叶可触及4cm的甲状腺结节，而在右侧检查不到甲状腺组织，放射性碘甲状腺扫描显示右侧有放射性浓聚结节影，采取下列何种治疗最为合适
A. 结节部位经皮穿刺检查
B. 甲状腺素100μg/L，连续6个月以抑制结节
C. 丙基硫氧嘧啶治疗一个阶段后手术切除甲状腺结节
D. 用放射性碘去除甲状腺结节
E. 促甲状腺激素（TSH）肌注，1次/天，连续8天，继以放射性碘去除甲状腺结节

正确答案：C。丙基硫氧嘧啶治疗一个阶段后手术切除甲状腺结节